认为健康是人类从事其他一切活动的前提和基础的是
A. 帕森斯
B. 经济学家
C. 阿马蒂亚
D. 舒尔茨
E. 政治学家

正确答案：C。阿马蒂亚

解析：本题考查阿马蒂亚的观点。诺贝尔奖获得者阿马蒂亚（C对ABDE错）认为：健康是一项有着深刻内在价值的、人类最重要的可行能力，它是人类从事其他一切活动的前提和基础。